男，28岁，右膝内侧逐渐隆起伴隐痛半年。X片示：右胫骨干骺端有一破坏区，边缘呈膨胀性改变，中央有肥皂泡样阴影。诊断首先考虑
A. 骨软骨瘤
B. 骨巨细胞瘤
C. 骨肉瘤
D. 骨转移性癌
E. 骨囊肿

正确答案：B。骨巨细胞瘤

解析：青年男性患者，右膝内侧逐渐隆起伴隐痛半年（提示可能为肿瘤），X片示右胫骨干骺端有一破坏区，边缘呈膨胀性改变，中央有肥皂泡样阴影（骨巨细胞瘤的典型影像学表现），结合患者症状和影像学表现，诊断首先考虑右胫骨骨巨细胞瘤（B对）。骨软骨瘤（A错）X线表现为干骺端从皮质突向软组织的骨性突起。骨肉瘤（C错）X线片可见Codman三角或“日光射线”形态，肿瘤边界不清。骨转移性癌（D错）临床表现主要取决于原发肿瘤部位、性质和转移灶的部位。骨囊肿（E错）好发于长管骨干骺端，多无明显症状，X线片常表现为干骺端圆形或椭圆形界限清楚的溶骨性病灶。